以上药物属于长效避孕针剂的是
A. 复发甲地孕酮片
B. 复方左旋18甲长效避孕片
C. 53号抗孕片
D. 更炔诺酮注射液
E. 甲硅环

正确答案：D。更炔诺酮注射液

解析：更炔诺酮注射液属于长效的单孕激素避孕针剂。掌握“激素避孕”知识点。